以下哪项是指医务人员在临床场所对“健康者”和无症状“患者”的健康危险因素进行评价，实施个性化的预防干预措施来预防疾病和促进健康
A. 临床预防服务
B. 社区预防服务
C. 社会预防服务
D. 国家预防服务
E. 群体预防服务

正确答案：A。临床预防服务

解析：临床预防服务：是指医务人员在临床场所对“健康者”和无症状“患者”的健康危险因素进行评价，实施个性化的预防干预措施来预防疾病和促进健康。掌握“临床预防服务概述”知识点。